以下哪项不是银汞合金充填术的适应证
A. Ⅰ类洞的充填
B. Ⅱ类洞的充填
C. 经完善牙髓治疗的后牙的组织缺损修复
D. 缺损面积大的无髓牙全冠修复前的充填
E. Ⅲ类洞的充填

正确答案：E。Ⅲ类洞的充填

解析：本题考查牙体充填材料之银汞合金。Ⅲ类洞的充填（E错，为本题正确答案）不是银汞合金充填术的适应证。银汞合金充填适应证：①Ⅰ类和Ⅱ类洞的充填（AB对）。②后牙牙髓病、根尖周病经完善牙髓治疗后的牙体组织缺损的修复（C对）。③缺损面积大的无髓牙全冠修复前的充填（D对）。应用注意：牙冠有劈裂可能的牙体缺损（如隐裂），不宜做银汞合金充填。汞过敏的患者禁用。